下列哪项不是涎腺多形性腺瘤的病理特征
A. 肿瘤细胞的类型多样
B. 组织结构比较复杂
C. 腺上皮形成腺管样结构
D. 黏液软骨样区域
E. 骨样区域

正确答案：E。骨样区域

解析：本题考查多形性腺瘤的病理特征。下列骨样区域（E错，为本题正确答案）不是涎腺多形性腺瘤的病理特征。多形性腺瘤镜下肿瘤细胞的类型多样（A对），组织结构复杂（B对）。其基本结构为腺上皮、肌上皮、黏液、黏液样组织和软骨样组织。腺上皮形成腺管样结构（C对）。管腔内有粉染的均质性黏液。肌上皮细胞可分为浆细胞样、梭形、透明和上皮样四种形态，肌上皮细胞常与黏液样组织和软骨样组织相互过渡，即逐渐移行为黏液样组织和软骨样组织（D对）。肿瘤的间质较少，纤维结缔组织常发生玻璃样变性。肿瘤的包膜大多完整，但厚薄不一，包膜内可见有肿瘤细胞侵入，少数部分包膜消失，这种表现多见于黏液样组织的表面和腭部多形性腺瘤的近黏膜侧。